幽门梗阻
A. SB升高
B. AB升高
C. 两者均升高
D. 两者均不升高
E. 无

正确答案：C。两者均升高

解析：幽门梗阻由于胃无法排空易导致剧烈呕吐使富含HCl的胃液大量丢失而发生代谢性碱中毒。由于酸性物质丢失，血浆HCO₃⁻浓度上升，AB和SB均升高（AB对，故C为本题正确答案）。